—位来访者单位的同事，要求了解当事人心理治疗的情况，心理治疗师婉言谢绝，这是因为
A. 出于对来访者的尊重
B. 保持客观中立的立场
C. 不认识来访者的同事
D. 心理治疗的关系限定原则
E. 心理治疗的保密原则

正确答案：E。心理治疗的保密原则

解析：保密性原则是心理治疗的原则之一，它要求治疗者尊重患者的权利和隐私。由于心理治疗的特殊性和患者对治疗者的高度信任，他们常常把自己从不被人知道的隐私暴露出来，这些隐私可能涉及到个人在社会中的名誉和前途，或牵扯到与其他人的矛盾和冲突，若得不到保护和尊重，会造成恶劣影响。题中心理咨询师婉言谢绝来访单位同事对于当事人心理治疗情况的询问，是希望保护患者接受心理治疗的隐私，遵循的是保密原则（E对），而并不关乎对来访者是否尊重（A错）以及是否认识来访者的同事（C错）。中立性原则（B错）要求治疗者在心理治疗过程中保持中立的态度和立场，与题意无关。关系限定原则（D错）不是心理治疗的原则。